外邪由皮毛传人脏腑的途径，依次是
A. 络脉—孙脉—经脉
B. 孙脉—经脉—络脉
C. 经脉—孙脉—络脉
D. 络脉—经脉—孙脉
E. 孙脉-络脉—经脉

正确答案：E。孙脉-络脉—经脉

解析：外邪侵犯人体由表及里，先从皮毛开始。卫气充实与络脉，络脉散布于全身而密布与皮部，当外邪侵犯机体时，卫气首当其冲发挥其抗御外邪、保卫机体的屏障作用。络脉为经脉别出，孙络是络脉中最细小的络脉因此顺序为孙络-络脉-经脉（E对ABCD错）。